听宫的主治病证是
A. 乳痈
B. 气喘
C. 心悸
D. 目视不明
E. 齿痛

正确答案：E。齿痛

解析：该题主要考察腧穴的主治。听宫属于手太阳小肠经腧穴，位于耳屏正中与下颌骨髁突之间的凹陷中。听宫主治耳鸣、耳聋、聤耳等耳疾；齿痛（E对）。